男，50岁，车祸致枕部着地，昏迷1小时，查体：P50次/分，R12次/分，BP170/100mmHg，右枕部头皮挫伤灶，GCS5分，瞳孔左：右=4mm：2mm，左侧对光反射消失，右侧肢体偏瘫。最应该采取的治疗措施是
A. 大剂量糖皮质激素
B. 腰椎穿刺放脑脊液减压
C. 急诊开颅手术
D. 绝对卧床
E. 冬眠疗法

正确答案：C。急诊开颅手术

解析：车祸致枕部着地，瞳孔左：右=4mm：2mm（瞳孔正常直径为3-4mm，双侧瞳孔大小不等），左侧对光反射消失（双侧瞳孔不等且伴有对光反射减弱或消失以及神志不清，往往是中脑功能损害的表现）（九版诊断学P107），右侧肢体偏瘫（脑损伤的表现），昏迷，血压上升、脉搏变慢、呼吸深慢，GCS5分（重型脑外伤），因此诊断为重型脑损伤（P185）。患者出现偏瘫等的脑内损伤，最应该采取的治疗措施是急诊开颅手术（C对），清除血肿，防止颅内压升高。